下列属于自然灾害的有
A. 火山爆发
B. 疟疾
C. 食物中毒
D. 流行性乙型脑炎
E. 飞机失事

正确答案：A。火山爆发

解析：本题考查自然灾害。自然灾害是指给人类生存带来危害或损害人类生活环境的自然现象，包括干旱、高温、低温、寒潮、洪涝、山洪、台风、龙卷风、地震、海啸、滑坡、泥石流、雷暴、球状闪电、火山喷发（A对BCDE错）等。